治疗佝偻病肌注维生素D，肌注法剂量是
A. 20万IU～30万IU一次
B. 10万IU～20万IU一次
C. 30万IU～40万IU一次
D. 40万IU～50万IU一次
E. 50万IU一次

正确答案：A。20万IU～30万IU一次

解析：注射法治疗佝偻病：肌注维生素D，20万～30万IU，一般1次即可，1个月后随访若明显好转，改预防量1:3服维持，若好转不明显，可再肌注1次。掌握“维生素D缺乏性佝偻病”知识点。